一位患者，牙周治疗1周后，右下磨牙颊侧牙龈突然肿起，若诊断为急性牙周脓肿，请分析此患者脓肿形成的原因，除外
A. 治疗前是复杂袋
B. 洁治或刮治时，将牙石推向深部
C. 机体抵抗力下降
D. 刮治术不彻底
E. 牙髓治疗不彻底

正确答案：E。牙髓治疗不彻底

解析：本题考查牙周脓肿的发病因素。牙髓治疗不彻底（E错，为本题正确答案）会导致残髓炎，继而发展为根尖周脓肿而非牙周脓肿。治疗前是复杂袋（A对），迂回曲折、涉及多个牙面，脓性渗出物不能顺利引流；洁治或刮治时，将牙石推入牙周袋深部（B对）会损伤深部组织并造成感染；机体抵抗力下降（C对）；刮治术不彻底（D对）虽然袋口收紧，但袋底炎症仍然存在，且得不到引流，这些情况都易形成急性牙周脓肿。